无牙颌牙槽嵴顶的黏膜的特性是
A. 厚、松软
B. 厚度适中、韧
C. 薄
D. 厚度适中、干燥
E. B或D

正确答案：B。厚度适中、韧

解析：覆盖无牙颌牙槽嵴顶的黏膜为附着黏膜，又称咀嚼黏膜，表面为高度角化的复层鳞状上皮，黏膜固有层薄，与骨膜结合紧密，活动度小。附着黏膜厚度适中，有一定的弹性，能承受咀嚼压力。掌握“无牙颌的解剖标志及功能分区”知识点。